为加强医疗机构抗菌药物临床应用管理，卫生部在发布了《抗菌药物临床应用管理办法》，其发布后开始施行的时间是
A. 40292
B. 41000
C. 41023
D. 41122
E. 41145

正确答案：D。41122

解析：为加强医疗机构抗菌药物临床应用管理，规范抗菌药物临床应用行为，提高抗菌药物临床应用水平，促进临床合理应用抗菌药物，控制细菌耐药，保障医疗质量和医疗安全，2012年4月24日卫生部发布了《抗菌药物临床应用管理办法》，自2012年8月1日起施行。掌握“抗菌药物临床应用概述及管理”知识点。